以下哪项不属于抗心律失常药的分类
A. 钠通道阻滞药
B. 钙拮抗药
C. 选择性延长复极的药物
D. 精神抑制剂
E. β肾上腺素受体阻断药

正确答案：D。精神抑制剂

解析：抗心律失常药的分类：I类——钠通道阻滞药；Ⅱ类——β肾上腺素受体阻断药；Ⅲ类——选择性延长复极的药物；Ⅳ类——钙拮抗药。掌握“抗心律失常药”知识点。